有关片剂崩解时限的错误表述是
A. 分散片的崩解时限为60分钟
B. 糖衣片的崩解时限为60分钟
C. 薄膜衣片的崩解时限为60分钟
D. 压制片的崩解时限为l5分钟
E. 浸膏片的崩解时限为60分钟

正确答案：A、C。分散片的崩解时限为60分钟；薄膜衣片的崩解时限为60分钟

解析：本题考查片剂的崩解时限。分散片的崩解时限为3分钟（A错，为本题正确答案）；薄膜衣片的崩解时限为30分钟（C错，为本题正确答案）；糖衣片的崩解时限为60分钟（B对）；压制片的崩解时限为15分钟（D对）；浸膏片的崩解时限为60分钟（E对）。